关于描述性研究的叙述，下列哪项是错误的
A. 生态学研究的类型包括比较研究和趋势研究
B. 生态学研究可用于评价干预试验的效果
C. 描述性研究可直接验证病因假设
D. 描述性研究属观察法

正确答案：C。描述性研究可直接验证病因假设

解析：本题考查描述性研究的用途。描述性研究的用途为：①描述疾病或者健康状况的分布及发生发展的规律；②获得病因线索，提出病因假设（C错，为本题正确答案）。